微囊藻毒素MC-LR的主要损伤的靶器官是
A. 脑
B. 肾脏
C. 胃
D. 肝脏
E. 肠道

正确答案：D。肝脏

解析：本题考查微囊藻毒素MC-LR的主要损伤的靶器官。微囊藻毒素的毒效应具有明显的器官选择性，其主要靶器官为肝脏、肾脏、肠、脑等，以肝脏（D对ABCE错）毒效应最为显著。研究表明，肝细胞中表达的有机阴离子转运多肽将微囊藻毒素转入细胞内是肝脏成为靶器官的重要原因。